花生仁被黄曲霉污染，最好的去毒方法是
A. 碾轧加工法
B. 紫外线照射法
C. 挑选霉粒法
D. 加水搓洗法
E. 加碱去毒

正确答案：C。挑选霉粒法